对单硝酸异山梨酯描述错误的是
A. 原是硝酸异山梨酯的活性代谢物
B. 作用时间达6h
C. 脂溶性大于硝酸异山梨酯
D. 无肝脏的首关代谢
E. 作用机制为释放NO血管舒张因子

正确答案：C。脂溶性大于硝酸异山梨酯

解析：本题考查硝酸异山梨酯。硝酸异山梨酯为二硝酸酯，脂溶性大，易透过血脑屏障，有头痛的不良影响。其活性代谢产物5-单硝酸异山梨酯，脂溶性较小（C错，为本题正确答案），同样具有抗心绞痛活性。硝酸异山梨酯在肝脏代谢为5-单硝酸异山梨酯（A对），该药物在胃肠道吸收迅速，无肝脏首关代谢（D对），生物利用度可达100%，作用持续3～6h（B对），其抗心绞痛的作用机制是释放血管舒张因子NO而舒张血管平滑肌（E对）。